因新陈代谢旺盛，用药要防止水电解质平衡紊乱的是
A. 早产儿
B. 新生儿
C. 婴幼儿
D. 儿童
E. 成年人

正确答案：D。儿童